女，38岁，右肩部外伤后疼痛、活动受限2小时。查体：右侧肩胛盂处有空虚感，Dugas征阳性。X线检查未见骨折，首选的治疗方法是
A. 外展支具固定
B. 肩部绷带固定
C. 三角巾悬吊固定
D. 切开复位
E. 麻醉下Hippocrates法复位

正确答案：E。麻醉下Hippocrates法复位

解析：患者右肩部外伤后疼痛、活动受限，查体右肩胛盂处有空虚感、Dugas征阳性，X线检查未见骨折，故诊断为肩关节脱位。无论肩关节脱位的类型及肱骨头所处位置，均应首先采用手法复位，首选治疗方法为麻醉下Hippocrates法复位（E对）。外展支具固定（P622）（A错）用于肩关节周围骨折。肩部绷带固定（B错）或三角巾悬吊固定（C错）为肩关节复位后固定方法。切开复位（P632）（D错）主要用于陈旧性肩关节脱位及合并神经血管断裂伤的肩关节脱位。